饮片处方调配复核的主要内容有
A. 有无虫蛀、霉变
B. 毒麻药有无超量
C. 剂量误差是否在允许范围内
D. 特殊煎法的药味是否单包
E. 有无错味、漏味、多味、异味

正确答案：A、B、C、D、E。有无虫蛀、霉变；毒麻药有无超量；剂量误差是否在允许范围内；特殊煎法的药味是否单包；有无错味、漏味、多味、异味

解析：本题考查的是饮片调配复核内容。饮片处方调配复核的主要内容有无虫蛀、霉变（A对）、毒麻药有无超量（B对）、剂量误差是否在允许范围内（C对）、特殊煎法的药味是否单包（D对）与有无错味、漏味、多味、异味（E对）。中药饮片调配复核内容：中药饮片调配后，必须经复核后方可发出。核对调配好的药品是否与处方所开药味及剂数相符，有无错味、漏味、多味和掺杂异物，每剂药的剂量误差应小于±5%，必要时要复称。还需审查有无配伍禁忌（十八反、十九畏）、妊娠禁忌药物，毒麻药有无超量。毒性中药、贵细药品的调配是否得当。对于需特殊煎煮或处理的药味如先煎、后下、包煎、烊化、另煎、冲服等是否单包并注明用法。审查药品质量，保证无伪劣饮片，审查有无虫蛀、发霉变质，有无生炙不分或以生代炙，整药、籽药应捣未捣，调配处方有无乱代乱用等现象。